脊柱结核发生率最高的部位是
A. 腰椎
B. 颈椎
C. 胸椎
D. 骶椎
E. 尾椎

正确答案：A。腰椎

解析：脊柱结核发生率最高的部位是腰椎（A对），其次是胸椎（C错）、颈椎（B错），而骶椎（D错）、尾椎（E错）结核罕见。